深静脉血栓的溶栓治疗，宜选用的药物是
A. 达比加群酯
B. 氯吡格雷
C. 尿激酶
D. 依诺肝素钠
E. 华法林

正确答案：C。尿激酶

解析：本题考查尿激酶。深静脉血栓的溶栓治疗，宜选用的药物是尿激酶（C对）。达比加群酯（A错）是最前沿的新一代口服抗凝药物直接凝血酶抑制剂(DTIs），用于预防非瓣膜性房颤患者的卒中和全身性栓塞，达比加群酯可提供有效的、可预测的、稳定的抗凝效果，同时较少发生药物相互作用，无药物食物相互作用，无需常规进行凝血功能监测或剂量调整。氯吡格雷（B错）用于近期心肌梗死（从几天到小于35天）、近期缺血性卒中（从7天到小于6个月）、非心源性栓塞性缺血性脑卒中或确诊外周动脉性疾病及急性冠脉综合征，非ST段抬高性急性冠脉综合征（包括不稳定性心绞痛或非Q波心肌梗死），包括经皮冠状动脉介入术后置入支架，ST段抬高性急性冠脉综合征的患者预防动脉粥样硬化血栓形成事件。依诺肝素钠（D错）用于预防静脉栓塞性疾病，尤其与某些手术有关的栓塞；也用于血液透析体外循环中，防止血栓形成等。华法林（E错）可抑制羧基化酶，对已经合成的凝血因子Ⅱ、Ⅶ、Ⅸ、X并无直接对抗作用，必须等待这些因子在体内相对耗竭后，才能发挥抗凝效应，所以本药起效缓慢，仅在体内有效，停药后药效持续时间较长。适用于预防、治疗深静脉血栓及肺栓塞，预防心肌梗死后、心房颤动、心瓣膜疾病或人工瓣膜置换术后引起的血栓栓塞并发症。